正常足月新生儿出生体重平均是
A. 2kg
B. 3kg
C. 4kg
D. 5kg
E. 6kg

正确答案：B。3kg

解析：本题考查体重的相关内容。出生体重是在出生后第一小时内第一次称得的重量。足月新生儿平均出生体重为3千克（B对ACDE错），正常范围2.5～4千克，女婴比男婴轻一些。